由于人类生产、生活等活动使天然环境发生改变的自然环境称为
A. 原生环境
B. 社会环境
C. 生活环境
D. 生产环境
E. 次生环境

正确答案：E。次生环境

解析：次生环境是指由于人类生产、生活以及社会交往等活动使天然形成的环境条件发生改变的自然环境，如生活环境与生产环境。掌握“环境卫生与职业卫生”知识点。